《中国药典》（一部）规定，应测定浸出物的药材是
A. 蒲公英
B. 石斛
C. 降香
D. 大蓟
E. 麻黄

正确答案：C。降香

解析：本题考查的是浸出物测定。《中国药典》（一部）规定，应测定浸出物的药材是降香（C对）。浸出物测定，对某些暂时无法建立含量测定项的中药，或已有含量测定项的中药，为了更全面地控制中药的质量，一般可根据该中药已知化学成分的类别，结合用药习惯、中药质地等，选用适宜溶剂为溶媒，测定中药中可溶性物质的含量，用以控制中药的质量。通常选用水、一定浓度的乙醇（或甲醇）、乙醚作溶剂，用冷浸法或热浸法做中药的浸出物测定。测定用的供试品须粉碎，使能通过二号筛，并混合均匀，按《中国药典》规定的方法进行测定。测定时根据《中国药典》规定的溶剂，或根据已知成分的溶解性质选用溶剂。如《中国药典》规定降香的乙醇浸出物不得少于8.0%；黄芪的水溶性浸出物不得少于17.0%。